腹股沟斜疝，行疝修补时易损伤的是
A. 输精管睾丸部
B. 输精管精索部
C. 输精管腹股沟管部
D. 输精管盆部
E. 射精管

正确答案：C。输精管腹股沟管部

解析：输精管腹股沟管部（C对）全程位于腹股沟管的精索内，当腹股沟斜疝行疝修补时易损伤精索，故也易损伤精索内的输精管。